马钱子的用量
A. 0.3～0.6g
B. 0.09～0.12g
C. 0.2～0.35g
D. 4～5g
E. 2.5～3g

正确答案：A。0.3～0.6g

解析：本题考查的是马钱子的用法用量。马钱子拔毒消肿敛疮药，味苦性温，有大毒，内服用量为0.3～0.6g（A对）。马钱子：【用法用量】内服：炮制后入丸散，0.3～0.6g。外用：适量，研末调敷。